择期胃手术一周后腹胀，肠鸣音减弱或无，反复呕吐，首先应采取
A. 作胃镜检查，查明原因
B. 胃肠减压、支持治疗
C. 剖腹检查，解除梗阻
D. 输液补钾
E. 肌注阿托品

正确答案：B。胃肠减压、支持治疗

解析：择期胃手术一周后腹胀，肠鸣音减弱或无，反复呕吐，提示吻合口梗阻。吻合口梗阻多由于吻合口过小或吻合时内翻过多，加上术后吻合口水肿所致，梗阻后由于肠道缺乏食物刺激，肠蠕动减弱，可引起腹胀、肠鸣音减弱或消失。首先采取的处理方法是胃肠减压，减轻胃内积气，改善胃壁血运、减轻炎症水肿，促进胃肠蠕动恢复；患者反复呕吐，应行补液等支持治疗，以纠正水、电解质和酸解平衡紊乱（B对）。如非手术治疗失败，再行剖腹探查，解除梗阻（C错）。患者术后一周尚不能耐受胃镜检查（A错）。患者无低钾表现，故不需要补钾（D错）。阿托品可松弛内脏平滑肌，降低胃肠蠕动，肌注阿托品可加重患者腹胀，故不能应用（E错）。